来院就诊的25岁妊高症初孕妇，对估计病情及决定处理方案最有价值的辅助检查方法是
A. 全血粘度比值和血浆粘度比值
B. 测定红细胞压积
C. 眼底检查
D. 测定血谷丙转氨酶值
E. 测定尿雌激素/肌酐值

正确答案：C。眼底检查

解析：妊高症的基本病理生理变化是全身小血管痉挛；对估计病情及决定处理方案最有价值的辅助检查方法是眼底检查（C对），其能观察到眼底小血管的痉挛程度，是子痫前期-子痫严重程度的重要参考指标。全血黏度比值和血浆黏度比值（A错）只能了解是否为妊高症的好发人群；测定红细胞压积（B错）能了解血容量多少；测定血谷丙转氨酶值（D错）主要用于肝功能的检查；测定雌激素/肌酐比值（P152）（E错）用于估计胎儿胎盘单位功能，均不是对估计病情及决定处理方案最有价值的辅助检查方法。